下列关于右冠状动脉的描述何者正确
A. 起自主动脉弓
B. 起自升主动脉
C. 分出前、后室间支
D. 发出前室间支和旋支
E. 分支分布于室间隔前2/3

正确答案：B。起自升主动脉

解析：右冠状动脉起于主动脉的冠状动脉右窦（B对A错）。分为后室间支和右旋支（CD错）。